传播病毒危险性最大的血液成分是
A. 红细胞
B. 白细胞
C. 血小板
D. 血浆
E. 冷沉淀

正确答案：B。白细胞

解析：因接触病毒最早的细胞是白细胞（主要是B细胞、T细胞），其对病毒进行吞噬、消化并产生抗体来对抗血液中的病毒，因此白细胞（B对）为传播病毒危险性最大的血液成分。红细胞（A错）、血小板（C错）、血浆（D错）、冷沉淀（是新鲜冷冻血浆在4℃融解时不融的沉淀物，主要成分为Ⅷ因子、纤维蛋白原）（E错）均不参与机体抗病毒反应，不是病毒的藏身所。